下列肺炎中最易并发肺脓肿的是
A. 真菌性肺炎
B. 干酪性肺类
C. 金黄色葡萄球菌肺炎
D. 肺炎支原体肺炎
E. 肺炎链球菌肺炎

正确答案：C。金黄色葡萄球菌肺炎

解析：金黄色葡萄球菌肺炎（C对）是由金黄色葡萄球菌引起的急性肺化脓性炎症，金黄色葡萄球菌凝固酶为阳性，是并发肺脓肿的主要原因。真菌性肺炎（A错）也可并发肺脓肿，但不如金黄色葡萄球菌肺炎多见。干酪性肺类（B错）是继发型肺结核，其病理变化是干酪样坏死，不易并发肺脓肿。肺炎支原体肺炎（D错）易并发社区获得性肺炎 （CAP） 。肺炎链球菌肺炎（E错）是由肺炎链球菌 （SP）或称肺炎球菌所引起的肺炎，溶血性链球菌可并发肺脓肿，但不如金黄色葡萄球菌肺炎多见。